糖尿病痰湿体胖者，长期坚持运动锻炼中，下列哪项是不适宜的
A. 有氧运动
B. 在下午2～4时进行
C. 长时间运动
D. 无氧运动
E. 循序渐进

正确答案：D。无氧运动

解析：无氧运动会加重体内缺氧状态，有诱发心脑血管疾病的风险，伴有心脑血管病的糖尿病患者不适合进行。剧烈的无氧运动还会导致乳酸堆积，还会导致低血糖的风险增加，所以对于糖尿病患者尤其是伴有慢性并发症者不宜进行无氧运动（D错，为本题正确答案）。糖尿病肥胖患者，一般应该选择在饭后1小时开始无氧运动，每次运动三十到六十分钟，每周三到五次，且应循序渐进、长期坚持（ABCE对）。